患者，女，34岁，已婚。4年前因患子宫肌瘤自然流产一次，现妊娠43天，阴道不时少量下血，腰酸，胎动下坠，口干不欲饮，舌暗红，脉沉弦。治疗应首选
A. 下瘀血汤
B. 固下益气汤
C. 补肾安胎饮
D. 加味圣愈汤
E. 桂枝茯苓丸

正确答案：E。桂枝茯苓丸

解析：患者患子宫肌瘤，素有癥积，现妊娠43天，腰酸，阴道有少量出血是因为癥积瘀血阻碍其长养，胎元不固；舌暗红，脉沉弦是血瘀之证,治疗用桂枝茯苓丸活血化瘀，补肾安胎（E对）。下瘀血汤治疗产后瘀血阻滞腹痛及瘀血阻滞，经水不利（A错）。固下益气汤治疗气虚下陷，气不摄精所导致的男子遗精，女子带下过多，月经过多，胎元不固并伴有气虚证主要表现（B错）。补肾安胎饮功效固肾安胎，主肾虚胎动不安证（C错）。加味圣愈汤功效补气，补血，摄血，用于气血虚弱，气不摄血证，多见月经先期而至，量多色淡，四肢乏力，体倦神疲（D错）。